符合浅昏迷的临床表现是
A. 对疼痛刺激有反应
B. 可以唤醒
C. 无意识的自主运动消失
D. 四肢腱反射消失
E. 定向力障碍

正确答案：A。对疼痛刺激有反应

解析：意识障碍可分为嗜睡、意识模糊、昏睡、谵妄和昏迷。轻度昏迷时，患者意识大部分丧失，无自主运动。被动体位，对外界事物、声、光刺激无反应，不能被唤醒（B错），对疼痛刺激有反应（A对）。无意识的自主运动（C错）如各种反射（D错）及生命体征无明显改变。四肢腱反射消失见于深度昏迷（P62），定向力障碍（E错）为意识模糊的临床表现（P61）。